不能识别游离抗原，只能识别被抗原提呈细胞处理过并和MHC分子结合的抗原肽的免疫细胞是
A. T细胞
B. B细胞
C. 树突细胞
D. NK细胞
E. 单核-巨噬细胞

正确答案：A。T细胞

解析：本题考查NK细胞、抗原提呈及其他免疫细胞。T细胞（A对）不能识别游离的抗原，只能识别被抗原提呈细胞加工提呈的并和MHC分子结核的抗原肽。